合理用药的基本原则包括
A. 安全
B. 有效
C. 迅速
D. 简便
E. 经济

正确答案：A、B、D、E。安全；有效；简便；经济

解析：本题考查的是合理用药的基本原则。合理用药的基本原则包括安全（A对）、有效（B对）、简便（D对）与经济（E对）。合理用药的基本原则就是安全、有效、简便、经济，四者缺一不可。既要权衡患者应用药物所获得的收益，又要考虑用药后对患者可能造成的伤害；既要考虑药物的疗效与治疗疾病的需要，又要顾及患者的经济承受能力及保护卫生资源与生态环境。并以此为宗旨，制定出最好的药物治疗方案，进而达到：最大限度地发挥药物的治疗效果，减少药物不良反应的发生；有效地防治疾病，提高患者的生命质量，降低发病率；控制医疗保健费用的过度增长，使社会和患者都获得最佳效益。迅速（C错）不属于合理用药的基本原则。